初产妇，足月妊娠，宫口开全1小时30分尚未分娩。阴道检查：头先露，宫口开全，胎头位于坐骨棘水平下3cm，枕左横位（LOT），胎膜已破，羊水清，胎心率140次/分，估计胎儿重3200g。本例正确处理应是
A. 行剖宫产术
B. 缩宫素静脉滴注
C. 等待阴道自然分娩
D. 徒手将胎头枕部转向前方，然后阴道分娩
E. 行产钳助产术

正确答案：D。徒手将胎头枕部转向前方，然后阴道分娩

解析：初产妇足月妊娠，宫口开全1小时30分（＜2小时），头先露，胎头位于坐骨棘水平下3cm，枕左横位（LOT），应诊断为胎位异常（持续性枕横位）。枕横位下降过程中内旋受阻，成为持续性枕横位时，需用手或胎头吸引术将胎头转成枕前位，然后胎头继续下降，进行阴道分娩（D对C错），若自然分娩困难，可行阴道产钳助产术（E错）。若S≤+2，才考虑行剖宫产术（P210）（A错）。静脉滴注缩宫素（P189）（B错）适用于协调性宫缩乏力、宫口扩张≥3cm、胎心良好、胎位正常、头盆相称者。